女性青春期是指
A. 月经来潮及第二性征发育
B. 子宫、卵巢等性器官的发育
C. 体内性激素水平增高至有生育功能
D. 生殖器官发育伴有心理变化
E. 生殖器官及其功能开始发育至成熟

正确答案：E。生殖器官及其功能开始发育至成熟

解析：本题考查女性青春期的相关内容。青春期是由儿童期向性成熟期过渡的一段快速生长发育时期，是儿蛮到成人的转变期。女性青春期即是指自乳房等第二性征开始发育至生殖器官及其功能逐渐发育成熟（E对ABCD错），获得生殖能力（性成熟）的一段生长发育期。